联系舌根，分散于舌下的经脉是
A. 足厥阴肝经
B. 足少阴肾经
C. 足太阴脾经
D. 足阳明胃经
E. 足少阳胆经

正确答案：C。足太阴脾经

解析：本题考查各经脉循行路线。足厥阴肝经过阴器，连目系，环唇内（A错）。足少阴肾经循喉咙，夹舌本（B错）。足太阴脾经 夹咽，连舌本，散舌下（C对）。足阳明胃经起于鼻，入上齿，环口夹唇，循喉咙（D错）。足少阳胆脉，起于目锐眦，下耳后，入耳中，出耳前（E错）。记忆：表1-2，这个表非常重要，要牢记经脉与哪些器官联络